在受体介导的细胞内信号传导系统中，不属于第二信使的是
A. 蛋白激酶C
B. 钙离子
C. 二酰甘油
D. 前列腺素
E. 一氧化氮

正确答案：A。蛋白激酶C

解析：本题考查第二信使的分类。在受体介导的细胞内信号传导系统中，不属于第二信使的是蛋白激酶C（A错，为本题正确答案）。